男，38岁。右膝关节、右踝关节持续性肿痛2个月。既往腰痛14年，伴晨僵，活动后改善。查体：右膝及右踝关节肿胀，有压痛，右膝关节积液，枕墙距2cm，双侧“4”字试验（+）。实验室检查：血常规WBC13.2×10⁹/L，Plt383×10⁹/L；ESR78mm/h；RF（-）；HLA－B27（+）。最可能的诊断是
A. 化脓性关节炎
B. 强直性脊柱炎
C. 骨关节炎
D. 类风湿性关节炎
E. 痛风性关节炎

正确答案：B。强直性脊柱炎

解析：青年男性患者，既往腰痛14年、伴晨僵、活动后改善（强直性脊柱炎典型表现），双侧“4”字试验（+）（提示髋关节病变），实验室检查：WBC13.2×10⁹/L（高于正常值4～10×10⁹/L），Plt383×10⁹/L（高于正常值100～300×10⁹/L），ESR78mm/h（高于男性正常值0～15 mm/h），提示患者可能处于炎症病情活动期。HLA-B27（+）（强直性脊柱炎HLA-B27阳性率高达88%～96%），结合患者症状、体征和实验室检查，最可能的诊断是强直性脊柱炎（B对）。化脓性关节炎（P746）（A错）好发于儿童，起病急，主要表现为寒战、高热等感染中毒症状，可有浮髌试验阳性。骨关节炎（P761）（C错）为一种以关节软骨退行性变和继发性骨质增生为特征慢性关节疾病，活动时疼痛加剧。类风湿性关节炎（D错）（P766）好发于手、腕、足等小关节，呈对称分布。风湿性关节炎（E错）表现为反复发作，疼痛呈游走性，可见皮下结节和环形红斑。